在规定介质中可以按要求缓慢非恒速释放药物的是
A. 固体分散体
B. 缓释制剂
C. 微囊
D. 免疫微球
E. 脂质体

正确答案：B。缓释制剂

解析：本题考查的是缓释制剂的特点。在规定介质中可以按要求缓慢非恒速释放药物的是缓释制剂（B对）。缓释制剂系指在规定释放介质中，按要求缓慢地非恒速释放药物，其与相应的普通制剂比较，给药频率比普通制剂减少一半或给药频率比普通制剂有所减少，且能显著增加患者的顺应性的制剂。固体分散体（A错）：是指药物与载体混合制成的高度分散的固体分散物。制备成固体分散体的技术称为固体分散技术。固体分散技术将药物以分子、胶态、微晶或无定形状态分散在水溶性材料、难溶性或肠溶性材料中形成固体分散体。微囊（C错）、免疫微球（D错）与脂质体（E错）属于靶向制剂。按照靶向作用方式，靶向制剂可分为：1）被动靶向制剂，即自然靶向制剂。常见的有微囊、微球和脂质体。2）主动靶向制剂，包括前体药物和经过修饰的药物载体两大类。修饰的药物载体主要有：①修饰的脂质体：如长循环脂质体、免疫脂质体、糖基修饰的脂质体；②修饰的微球，采用聚合物将抗原、抗体吸附或交联成微球，称为免疫微球；③其他，如修饰的微乳、修饰的纳米球等。3）物理化学靶向制剂，主要有：①磁性制剂，如磁性微球、磁性纳米囊；②栓塞靶向制剂；③热敏靶向制剂；④pH敏感靶向制剂。